脱水山梨醇月桂酸酯的商品名为
A. 司盘20
B. 十二烷基苯磺酸钠
C. 苯扎溴铵
D. 卵磷脂
E. 吐温80

正确答案：A。司盘20

解析：本题考查脱水山梨醇月桂酸酯的商品名。脱水山梨醇月桂酸酯商品名为司盘20（A对）。十二烷基苯磺酸钠（B错）为阴离子表面活性剂。苯扎溴铵（C错）为阳离子表面活性剂。卵磷脂（D错）为两性离子表面活性剂。吐温80（E错）为聚山梨酯的商品名。